香豆素类过量中毒选用
A. 铁剂
B. 叶酸
C. 维生素B
D. 维生素K
E. 肝素

正确答案：D。维生素K